可摘局部义齿出现基托与组织不密合，边缘封闭不好的现象解决的方案为
A. 修改卡环臂
B. 基托重衬
C. 基托缓冲
D. 重新排列人工牙
E. 修改卡环与支托，或重新制作卡环

正确答案：B。基托重衬

解析：基托与组织不密合，边缘封闭不好：常发生在游离端义齿和缺牙数目多的义齿，没有充分发挥吸附力和大气压力的固位作用，应进行基托重衬处理。掌握“局部义齿修复后出现的问题及处理”知识点。